高科技应用在医学中所产生的伦理负效应主要表现为下列现象，但应除外的是
A. 诊治依赖高科技手段
B. 高技术-低情感
C. 高技术手段集中于“三级医院”中
D. 滥用高科技手段，造成看病贵
E. 医患关系的“物化”趋势

正确答案：E。医患关系的“物化”趋势